影响药物制剂稳定性的非处方因素是
A. pH
B. 温度
C. 溶剂
D. 离子强度
E. 表面活性剂

正确答案：B。温度

解析：本题考查影响药物制剂稳定性的因素。影响药物制剂稳定性的非处方因素是温度（B对）。温度的影响属于外界因素，不是处方因素。影响药物制剂稳定性的因素包括处方因素和外界因素。其中，处方因素包括pH值（A错）、广义酸碱催化反应、溶剂（C错）、离子强度（D错）、表面活性剂（E错）、处方中基质以及赋形剂。外界因素包括温度、光线、空气（氧）、金属离子、湿度和水分、包装材料。